关于新生儿保健要点，错误的是
A. 注意保暖
B. 告诉母亲定时哺喂母乳
C. 预防交叉感染
D. 加强皮肤、脐带的护理
E. 给予适宜感知觉刺激

正确答案：B。告诉母亲定时哺喂母乳

解析：本题考查新生儿的保健要点。新生儿喂养不需要定时和定量（B错，为本题正确答案），应根据新生儿的需要和母乳膨胀情况来确定。新生儿期的保健要点：（1）环境温度：新生儿要注意保暖（A对），防止着凉；（2）喂养：尽早吸吮母乳，指导母亲正确的哺乳方法；（3））护理：新生儿皮肤娇嫩，保持皮肤清洁，特别注意保持脐带残端清洁和干燥（D对）；选择合适的衣服等；（4）促进感知觉（E对）、运动发育；（5）预防感染：新生儿居室保持空气新鲜；避免交叉感染（C对）；新生儿的用具每日煮沸消毒等；（6）伤害预防 ：注意喂哺姿势、喂哺后的体位，预防乳汁吸入和窒息，预防意外伤害的发生。